引起心肌损害导致舒缩功能障碍的直接因素是
A. 动脉瓣膜关闭不全
B. 室间隔缺损
C. 高血压
D. 心肌炎
E. 肺源性心脏病

正确答案：D。心肌炎

解析：病毒性心肌炎（D对）可通过病毒感染或其介导的免疫损伤直接引起心肌细胞损害，导致舒缩功能障碍。动脉瓣膜关闭不全（A错）、室间隔缺损（B错）、高血压（C错）、肺源性心脏病（E错）均引起心室负荷过重，使心肌发生适应性改变（代偿），但若长期负荷过重，超过心肌适应能力（失代偿），则会导致心肌舒缩功能障碍。A、B、C、E选项并非通过直接损害心肌的方式导致心肌舒缩功能障碍，而是通过使心脏长期负荷过重最后失代偿导致的。